黏膜局部抵御病原微生物感染的重要屏障，是人体的黏膜防御屏障的是
A. PP
B. FDC
C. PALS
D. MALT
E. spleen

正确答案：D。MALT

解析：MALT是人体的黏膜防御屏障，其中的B细胞受抗原刺激后产生大量SIgA，经黏膜上皮细胞分泌至黏膜表面，构成黏膜局部抵御病原微生物感染的重要屏障。掌握“中枢和外周免疫器官”知识点。